专门从事心理治疗的人员在心理治疗活动中造成他人人身损害，应当
A. 吊销执业证书
B. 承担民事责任
C. 承担刑事责任
D. 给予警告批评
E. 责令暂停6个月以上1年以下执业活动

正确答案：B。承担民事责任

解析：专门从事心理治疗的人员在心理治疗活动中造成他人人身、财产或者其他损害的，依法承担民事责任。掌握“精神障碍康复及法律责任”知识点。